肺炎链球菌肺炎首选
A. 庆大霉素
B. 林可霉素
C. 红霉素
D. 氧氟沙星
E. 青霉素G

正确答案：E。青霉素G

解析：肺炎链球菌肺炎首选青霉素G（E对）。庆大霉素为氨基糖苷类抗生素，一般用于绿脓杆菌、克雷伯杆菌感染所致的肺炎等治疗（A错）。林可霉素抗菌谱与红霉素相似（B错），红霉素一般用于肺炎支原体、军团菌感染所致的肺炎等治疗（C错）。氧氟沙星（D错）为喹诺酮类抗菌药，对革兰阳性菌、衣原体、支原体的杀灭作强。